（牙合）支托作用不包括
A. 支持作用
B. 加大（牙合）支托以恢复咬合关系
C. 防止义齿龈向移位
D. 防止食物嵌塞
E. 美观作用

正确答案：E。美观作用

解析：（牙合）支托：是卡环伸向基牙（牙合）面而产生支持作用的部分，防止义齿龈向移位，可保持卡环在基牙上的位置。如果余留牙间有间隙，（牙合）支托安放其间可以防止食物嵌塞。如果基牙倾斜移位，与对颌牙接触不良或无（牙合）接触，还可加大（牙合）支托以恢复咬合关系。掌握“局部义齿的设计”知识点。